牙体遭受外力直接撞击，造成牙冠或牙根的折断称为
A. 牙震荡
B. 牙折
C. 牙脱位
D. 楔状缺损
E. 牙酸蚀症

正确答案：B。牙折

解析：牙折：外力直接撞击，造成牙冠或牙根的折断称为牙折。掌握“牙折”知识点。